二岁以下儿童腹泻，禁用药品是
A. 双八面体蒙脱石散
B. 双歧三联活菌胶囊
C. 洛哌丁胺片
D. 地衣芽孢杆菌胶囊
E. 口服补液盐

正确答案：C。洛哌丁胺片

解析：本题考查洛派丁胺。洛哌丁胺（C对）能够抑制肠蠕动，禁用于：2岁以下儿童、肠梗阻患者、应用广谱抗菌药物引起的假膜性肠炎者、细菌性小肠结肠炎患者。